布洛芬与阿司匹林比较其主要特点是
A. 抗炎、抗风湿作用较强
B. 解热作用较强
C. 镇痛作用较强
D. 胃肠道反应较轻
E. 长期服用诱发胃肠溃疡和出血较少

正确答案：D。胃肠道反应较轻